桩核冠的牙本质肩领厚度应大于
A. 1mm
B. 2mm
C. 3mm
D. 1.5mm
E. 0.5mm

正确答案：A。1mm

解析：本题考查牙本质肩领。桩核冠的牙本质肩领厚度应大于1mm（A对）。临床上常见无牙本质肩领设计的桩核冠修复体在使用过程中容易导致患牙的牙根折裂。因此当根面位于龈下时，需通过正畸方法行牙根牵引术或通过牙周手术行牙冠延长术来获得牙本质肩领。